舌的发育来源于
A. 第Ⅰ鳃弓
B. 第Ⅱ鳃弓
C. 第Ⅲ鳃弓
D. 第Ⅳ鳃弓
E. 以上都包括

正确答案：E。以上都包括

解析：舌发育来自第Ⅰ、Ⅱ、Ⅲ鳃弓的原始口腔和咽侧形成的隆起。而舌根来自于Ⅱ、Ⅲ、Ⅳ鳃弓位于中线形成的突起。故舌的发育来自于Ⅰ、Ⅱ、Ⅲ、Ⅳ鳃弓。掌握“腭部与舌的发育”知识点。